患者，男，23岁。右前臂内侧有红丝一条，向上走窜，停于肘部。用砭镰疗法的操作要点是
A. 沿红线两头，针刺出血
B. 梅花针沿红线打刺，微微出血
C. 用三棱针沿红线寸寸挑断，并微微出血
D. 用三棱针点刺出血
E. 梅花针沿红线打刺，微微出血，并加神灯照法

正确答案：C。用三棱针沿红线寸寸挑断，并微微出血

解析：该患者右前臂内侧有红丝一条，向上走窜，停于肘部的表现可诊断为红丝疔。红丝疔是发于四肢，皮肤呈红丝显露，迅速向上走窜的急性感染性疾病。若红丝疔细的宜用砭镰法，局部皮肤消毒后，以刀针沿红丝疔行走途径，寸寸挑断，并用拇指和食指轻捏针孔周围皮肤，微令出血，或在红丝尽头挑断，挑破处均盖贴太乙膏掺红灵丹（C对）（ABDE错）。